某男，35岁。春节期间突患急性胆囊炎，症见胁痛，口苦，舌红苔黄。证属肝胆湿热，医师依据其要求，给其处以方便服用的消炎利胆颗粒。药师在发药时告诉患者，药不宜久服，是因其处方中含一味有一定毒性的药，该药是
A. 黄连
B. 苦参
C. 苦木
D. 重楼
E. 穿心莲

正确答案：C。苦木

解析：本题考查的是清炎利胆颗粒的注意事项。春节期间突患急性胆囊炎，症见胁痛，口苦，舌红苔黄。证属肝胆湿热，医师依据其要求，给其处以方便服用的消炎利胆颗粒。药师在发药时告诉患者，药不宜久服，是因其处方中含一味有一定毒性的药，该药是苦木（C对）。消炎利胆颗粒：【注意事项】孕妇慎用。脾胃虚寒者慎用。服药期间，饮食宜清淡，忌食辛辣食物，并戒酒。用治急性胆囊炎感染时，应密切观察病情变化，若发热、黄疸、上腹痛等症加重则须及时请外科诊治。因其所含苦木有一定毒性，故不宜久服。黄连（A错）、苦参（B错）与重楼（D错）并非消炎利胆颗粒的药物组成成分。